用于治疗类风湿性关节炎是处方药，用于解热、镇痛是非处方药的是
A. 对乙酰氨基酚
B. 布洛芬
C. 西咪替丁
D. 氢化可的松
E. 氢溴酸右美沙芬

正确答案：B。布洛芬

解析：本题考查布洛芬。用于治疗类风湿性关节炎是处方药，用于解热、镇痛是非处方药的是布洛芬（B对）。布洛芬属于“双跨药”，用于治疗类风湿性关节炎是处方药，用于解热、镇痛是非处方药。对乙酰氨基酚（A错）为最常用的解热镇痛药，无抗炎抗风湿作用。西咪替丁（C错）为H₂受体拮抗剂。氢化可的松（D错）为糖皮质激素。右美沙芬（E错）为中枢性镇咳药。